关于胃的淋巴，下列哪项叙述是错误的
A. 胃小弯近侧2/3胃壁的淋巴回流至脾淋巴结
B. 胃大弯上2/3胃壁的淋巴回流至脾淋巴结
C. 胃大弯远侧2/3胃壁的淋巴回流至胃网膜左右淋巴结
D. 胃小弯近侧2/3胃壁的淋巴回流至幽门淋巴结
E. 胃底的淋巴回流至脾淋巴结

正确答案：A。胃小弯近侧2/3胃壁的淋巴回流至脾淋巴结

解析：胃小弯近侧2/3胃壁的淋巴回流至胃上淋巴结（A错，为本题正确答案）。胃大弯上2/3胃壁的淋巴回流至脾淋巴结（B对）。胃大弯远侧2/3胃壁的淋巴回流至胃网膜左右淋巴结（C对）。胃小弯近侧2/3胃壁的淋巴回流至幽门淋巴结（D对）。胃底的淋巴回流至脾淋巴结（E对）。